不属于社区卫生服务的实施的是
A. 制定计划
B. 人员培训
C. 建立组织机构
D. 服务的开展与评价
E. 提供大量经费

正确答案：E。提供大量经费

解析：本题考查社区卫生服务的实施内容。社区卫生服务的实施内容包括：制定计划（A对）、人员培训（B对）、建立组织机构（C对）、服务的开展与评价（D对）。提供经费（E错，为本题正确答案）不属于社区卫生服务的实施内容。